流行性脑脊髓膜炎败血症期患者皮肤瘀点的主要病理基础是
A. 血管脆性增强
B. 播散性血管内凝血（DIC）
C. 血小板减少
D. 小血管炎致局部坏死及栓塞
E. 凝血功能障碍

正确答案：D。小血管炎致局部坏死及栓塞

解析：小血管炎致局部坏死及栓塞（D对）为流行性脑脊髓膜炎败血症期出现皮肤和黏膜的广泛性出血点和瘀斑及周围循环衰竭等严重临床表现的病理基础。